在美国南达科他州，执业药师不得
A. 与任何人秘密协议瓜分费用
B. 与合伙人秘密协议瓜分费用
C. 拒绝开方或诊断
D. 使用秘密处方
E. 使用加密码处方

正确答案：A、B、D。与任何人秘密协议瓜分费用；与合伙人秘密协议瓜分费用；使用秘密处方